霍乱，副霍乱患者的大便性状为
A. 黏液便
B. 脓血便
C. 鲜血便
D. 米泔样便
E. 胨状便

正确答案：D。米泔样便

解析：霍乱肠毒素能促使肠黏膜杯状细胞分泌黏液增多，使水样便中含大量黏液。剧烈腹泻导致失水，胆汁分泌减少，霍乱患者和副霍乱患者的粪便可呈“米泔水”样（D对）。